乳牙患龋特点
A. 患龋率高，但范围不大
B. 患龋率高，范围广泛
C. 发病早，症状明显
D. 发展速度慢，急性龋多见
E. 龋齿多发，修复性牙本质形成不活跃

正确答案：B。患龋率高，范围广泛

解析：乳牙龋与恒牙龋相比，乳牙的患龋率高，龋齿多发、龋蚀范围广，龋蚀发展速度快，自觉症状不明显，修复性牙本质的形成活跃等特点。掌握“乳牙龋”知识点。